菟丝子的功效有
A. 补阳益阴
B. 明目止泻
C. 生津
D. 安胎
E. 固精缩尿

正确答案：A、B、C、D、E。补阳益阴；明目止泻；生津；安胎；固精缩尿

解析：本题考查的是菟丝子的功效。菟丝子的功效有补阳益阴（A对）、明目止泻（B对）、生津（C对）、安胎（D对）与固精缩尿（E对）。菟丝子：【功效】补阳益阴，固精缩尿，明目止泻，安胎，生津。